膝反射消失时禁用
A. 硫酸镁
B. 催产素
C. 麦角新碱
D. 前列腺素
E. 青霉素

正确答案：A。硫酸镁

解析：膝反射消失是硫酸镁中毒的表现，所以，出现此情况时，应禁用硫酸镁。掌握“娠期高血压疾病”知识点。